桥接坏死主要见于
A. 急性普通型肝炎
B. 慢性肝炎
C. 急性重型肝炎
D. 中、重度慢性肝炎
E. 亚急性重型肝炎

正确答案：D。中、重度慢性肝炎

解析：病毒性肝炎可分为普通型病毒性肝炎和重型病毒性肝炎。其中前者分急性肝炎和慢性肝炎两种类型，慢性肝炎又可分为轻度慢性肝炎、中度慢性肝炎和重度慢性肝炎；后者分急性重型肝炎和亚急性重型肝炎两种类型。肝细胞呈碎片状及桥接坏死主要见于中度慢性肝炎和重度慢性肝炎（D对）。急性重型肝炎（C错）（P199）主要见弥漫性大片坏死。亚急性重型肝炎（E错）（P199）主要见肝细胞的大片坏死及结节状肝细胞再生。轻度慢型肝炎（B错）（P198）主要见点状坏死，偶见轻度碎片状坏死。急性普通型肝炎（A错）（P198）主要见点状坏死。